患者，女，32岁，已婚。妊娠2个月，近日因恶阻而恶心呕吐，呕吐酸苦水，不能进食，胸满胁痛，舌红苔黄，脉弦滑。其证候是
A. 肝胃不和
B. 胃虚
C. 胃热
D. 痰滞
E. 以上均非

正确答案：A。肝胃不和

解析：患者妊娠两个月，妊娠恶阻，症见呕吐酸苦水，不能进食，胸满胁痛，舌红苔黄，脉弦滑是肝胃不和之征（A对E错）。胃虚证分胃气虚证、胃阳虚证、胃阴虚证，其中胃气虚证多表现为胃脘隐痛或痞胀、喜按，食少与气虚症状；胃阳虚证多表现为胃脘冷痛，喜温喜按，胃凉肢冷等；胃阴虚证多表现为胃脘嘈杂，饥不欲食，脘腹痞胀，灼痛等（B错）。胃热证以胃脘灼痛、消谷善饥等为主要表现的实热证候（C错）。痰滞证多表现为咳嗽痰多，痰质黏稠，胸脘痞闷，呕恶，纳呆，或头晕目眩，或形体肥胖，或神昏而喉中痰鸣等（D错）。